上颌第二前磨牙的邻面接触区位于
A. 切1/3偏舌侧
B. 切1/3偏唇侧
C. 中1/3偏舌侧
D. 中1/3偏（牙合）方
E. 近（牙合）缘偏颊侧

正确答案：E。近（牙合）缘偏颊侧

解析：上颌第二前磨牙的近远中接触区均在近（牙合）缘偏颊侧。掌握“固定桥的设计”知识点。